急性智牙冠周炎的治疗方法中应除外
A. 局部冲洗上药
B. 切开引流
C. 配合口服抗生素
D. 拔除患牙
E. 使用漱口液

正确答案：D。拔除患牙

解析：本题考查智齿冠周炎的治疗。急性智牙冠周炎的治疗方法中应除外拔除患牙（D错，为本题的正确答案）。急性炎症期一般不能拔牙，以免感染扩散。若急性冠周炎引起张口受限，则牙齿无法拔除。智齿冠周炎急性期的治疗：1.局部冲洗（A对）：常用生理盐水、1%～3%过氧化氢溶液、0.1%氯己定溶液等反复冲洗龈袋，至溢出液清亮。局部擦干后，探针蘸碘甘油或少量碘伏液入龈袋内，每天1～3次，并用温热水等含漱剂漱口（E对）。2.根据局部炎症、全身反应程度以及有无其他并发症等，选择抗菌药物及全身支持治疗（C对）。3.切开引流（B对）：如龈瓣附近形成脓肿，应及时切开并放置引流条。